地面水环境指数常用评价标准是
A. 生活饮用水水质标准
B. 选用参数的最高容许浓度
C. 污水综合排放标准
D. 农田灌溉水质标准
E. 送院污水排放标准

正确答案：B。选用参数的最高容许浓度

解析：本题考查水环境质量标准的相关内容。地面水环境指数常用评价标准是选用参数的最高容许浓度（B对ACDE错）。最高容许浓度系指某一外源化学物可以在环境中存在而不致对人体造成任何损害作用的浓度。